甲亢术后呼吸困难多发生于术后
A. 6小时以内
B. 12小时以内
C. 24小时以内
D. 48小时以内
E. 72小时以内

正确答案：D。48小时以内

解析：术后呼吸困难和窒息是术后最严重的并发症，多发生在术后48小时以内（D对）。常见原因为：①出血及血肿压迫气管；②喉头水肿；③气管塌陷；④双侧喉返神经损伤。